下列有关儿童少年心理健康的“标准”哪一条是不正确的
A. 由感知觉能力、记忆力、注意力、思维能力等综合而成的智力正常、发育正常
B. 有时情绪愉快，有时不愉快，反应适度
C. 不同年龄阶段都能表现出能被人普遍接受的心理特征，能集中注意力，耐受各种压力
D. 行为协调，对外部刺激反应适度，有一定应变能力
E. 能与周围的人建立协调的人际关系、和睦相处

正确答案：C。不同年龄阶段都能表现出能被人普遍接受的心理特征，能集中注意力，耐受各种压力